顺铂
A. 对心脏的影响最大
B. 对肾脏的影响最大
C. 对肺脏毒性最大
D. 对骨髓抑制最重
E. 发生腹泻最重

正确答案：B。对肾脏的影响最大

解析：顺铂是通过破坏DNA的抗肿瘤药物，具有抗瘤谱广，对乏氧肿瘤细胞有效的特点，对非精原细胞性睾丸瘤最有效。其主要的不良反应有消化道反应、骨髓抑制、周围神经炎、耳毒性，大剂量或连续用药可致严重而持久的肾毒性（B对）。对心脏的影响最大（A错）为阿霉素类药物的不良反应。对肺脏毒性最大（C错），较少有药物对肺脏产生毒性。对骨髓抑制最重（D错）为环磷酰胺。发生腹泻最重（E错）较少有抗肿瘤药物引起腹泻。